地图舌是一种
A. 慢性增生性舌炎
B. 急性萎缩性舌炎
C. 慢性剥脱性舌炎
D. 病毒感染性舌炎
E. 慢性营养不良性舌炎

正确答案：C。慢性剥脱性舌炎

解析：本题考查地图舌。地图舌是一种慢性剥脱性舌炎（C对），特征是舌背上有不规则圆形红斑，边缘稍隆起，由于丝状乳头剥脱而形成红色脱皮区。其病损的形态和位置多变，类似地图标示的蜿蜒国界。慢性增生性舌炎常见于毛舌（A错）。病毒感染性舌炎可见于疱疹性口炎，也可见于沟纹舌（D错）。慢性营养不良性舌炎可见于沟纹舌、舌乳头炎等（E错）。